桂枝汤的药物组成是
A. 桂枝、芍药、生姜、大枣、杏仁
B. 桂枝、芍药、杏仁、甘草、人参
C. 桂枝、芍药、大枣、生姜、甘草
D. 桂枝、芍药、麻黄。生姜。甘草
E. 桂枝、芍药、生姜、大枣、人参

正确答案：C。桂枝、芍药、大枣、生姜、甘草

解析：桂枝汤方含桂枝、芍药、大枣、生姜、甘草（C对），以解肌发表，调和营卫，主治外感风寒表虚证。桂枝汤方歌—桂枝汤治太阳风，芍药甘草姜枣同，解肌发表调营卫，汗出恶风此方功。